“V-Y”皮瓣成形术，可以
A. 增加皮肤长度，缩小宽度
B. 增加长度和宽度
C. 增加宽度，缩小长度
D. 缩小长度和宽度
E. 长度和宽度部未增加

正确答案：A。增加皮肤长度，缩小宽度

解析：本题考查皮瓣移植。“V-Y”皮瓣成形术，可以增加皮肤长度，缩小宽度（A对）。临床上，为了增长或缩短某一组织的长度和宽度而常用V-Y皮瓣成形术，也是属于滑行皮瓣的一种。在皮肤上作V形切口，分离三角形皮瓣及两侧皮下组织，利用组织的收缩性，使三角形皮瓣后退，再将切口缝为Y形，可以使皮肤的长度增加，宽度缩小。反之，在皮肤上作Y形切口，分离三角形皮瓣及对直切口两侧行潜行分离，利用组织的弹性，将三角形皮瓣向前推进，把切口缝合成V形，则可使皮肤的长度缩短，宽度增加。